目前我国的艾滋病流行处于
A. 传入期
B. 扩散期
C. 快速增长期
D. 静止期
E. 衰退期

正确答案：C。快速增长期